不属于口腔颌面部感染局部症状表现的是
A. 炎症急性期，局部表现红、肿、热、痛、功能障碍、引流区淋巴结肿痛等典型症状
B. 炎症累及咀嚼肌部位导致不同程度的张口受限
C. 腐败坏死性蜂窝组织炎的局部皮肤呈明显凹陷性水肿，可触及捻发音
D. 化验检查白细胞总数增高，中性粒细胞比例上升，核左移
E. 感染的慢性期，局部形成较硬的炎性浸润块，或形成长期排脓的窦（瘘）口

正确答案：D。化验检查白细胞总数增高，中性粒细胞比例上升，核左移

解析：本题考查口腔颌面部感染。不属于口腔颌面部感染局部症状表现的是化验检查白细胞总数增高，中性粒细胞比例上升，核左移（D错，为本题正确答案）。口腔颌面部感染的局部症状：化脓性炎症的急性期，局部表现为红、肿、热、痛、功能障碍、引流区淋巴结肿痛等典型症状（A对），但其程度因发生的部位、深浅，范围大小以及病程早晚而有差异。炎症累及咀嚼肌部位导致不同程度的张口受限（B对）；如病变位于口底、舌根、咽旁，可有进食、吞咽、语言甚至呼吸困难。腐败坏死性蜂窝组织炎的局部皮肤呈弥漫性水肿、紫红或灰白、无弹性，呈明显凹陷性水肿，由于组织间隙有气体产生可触及捻发音（C对）。感染的慢性期，局部形成较硬的炎性浸润块，并出现不同程度的功能障碍，或形成长期排脓的窦（瘘）口（E对）。当机体抵抗力减弱或治疗不彻底时，慢性感染可再度急性发作。